能化瘀止血的是
A. 丹参
B. 红花
C. 水蛭
D. 乳香
E. 五灵脂

正确答案：E。五灵脂

解析：本题考查的是五灵脂的功效。能化瘀止血的是五灵脂（E对）。五灵脂：【功效】活血止痛，化瘀止血，解蛇虫毒。丹参（A错）：【功效】活血祛瘀，通经止痛，清心除烦，凉血消痈。红花（B错）：【功效】活血通经，祛瘀止痛。水蛭（C错）：【功效】破血逐瘀，通经。乳香（D错）：【功效】活血止痛，消肿生肌。